关于肽键、肽链的说法错误的是
A. 多肽链就是肽链分子中的氨基酸相互衔接形成的长链
B. 肽链中的氨基酸分子因脱水缩合而有残缺
C. 肽链中残缺的氨基酸分子称为氨基酸残基
D. 蛋白质中没有氨基酸残基
E. 最简单的肽称为二肽

正确答案：D。蛋白质中没有氨基酸残基

解析：两分子氨基酸脱水缩合成为最简单的二肽。二肽能与很多的氨基酸进行成肽反应，连成多肽。肽链分子中的氨基酸相互衔接，形成的长链，称为多肽链。肽链中的氨基酸分子因脱水缩合而有残缺，故称为氨基酸残基。蛋白质就是许多氨基酸残基组成的多肽链。掌握“氨基酸与多肽及蛋白质结构”知识点。